为了有针对性地进行干预活动，对社区主要健康问题进行的诊断属于
A. 社会诊断
B. 教育诊断
C. 流行病学诊断
D. 行为与环境诊断
E. 管理与政策诊断

正确答案：C。流行病学诊断